劳累时有心绞痛及晕厥发作的主动脉瓣狭窄患者首选治疗为
A. 静点硝酸甘油
B. 强心
C. 利尿
D. 主动脉瓣瓣膜置换术
E. 主动脉瓣球囊成型术

正确答案：D。主动脉瓣瓣膜置换术

解析：动脉瓣狭窄时内科主要的治疗是预防感染型心内膜炎，无症状者无需治疗，应定期随访，一旦出现症状，即需手术治疗（ABC错），若不做瓣膜置换，3年死亡率可达75%，而动脉瓣狭窄患者主动脉瓣置换后，存活率接近正常。主动脉瓣瓣膜置换术（D对）为治疗成人主动脉瓣狭窄的主要方法，手术指征为重度狭窄伴心绞痛、晕厥或心力衰竭症状的患者。主动脉瓣球囊成形术（E错）有创伤小、耗资低等优点，但是不能降低远期死亡率，且临床应用范围局限，主要用于治疗高龄、有心力衰竭等手术的高危患者。